呼吸中枢的正常兴奋依赖于血液中
A. 高浓度的CO₂
B. 正常浓度的CO₂
C. 高浓度的O₂
D. 正常浓度的O₂
E. H+浓度

正确答案：B。正常浓度的CO₂